位于牙齿邻面或者窝沟底部的哪项结构被认为是龋病发展的有利通道
A. 芮氏线
B. 欧文线
C. 釉小皮
D. 釉质横纹
E. 釉板

正确答案：E。釉板

解析：釉板特别是在窝沟底部及牙齿邻面的釉板，被认为是龋病发展的有利通道。掌握“牙釉质”知识点。